镍铬合金基底冠铸造后，在烤瓷前可进行的处理，除了
A. 磨改外形
B. 试冠
C. 喷砂
D. 预氧化
E. 超声清洗

正确答案：D。预氧化

解析：本题考查镍铬合金基底冠在烤瓷前可进行的处理。镍铬合金基底冠铸造后不进行预氧化（D错，为本题的正确答案），是因为氧化的镍铬合金会释放游离金属离子，使周围的牙龈产生金属黑线。镍铬合金基底冠铸造后，在烤瓷前应试冠（B对）以确定金属基底冠是否合适，并做适当的磨改外形（A对），喷砂（C对）及超声清洗（E对）以清洁金属基底冠，来促进金瓷结合，提高制作烤瓷冠的成功率。